酒作为炮制辅料，其作用是
A. 引药入肝，散瘀止痛
B. 祛瘀散寒，行水消肿
C. 活血通络，祛风散寒
D. 强筋健骨，软坚散结
E. 润肠通便，解毒生肌

正确答案：C。活血通络，祛风散寒

解析：本题考查的是炮制辅料酒的作用。酒作为炮制辅料，其作用是活血通络，祛风散寒（C对）。中药炮制中常用的液体辅料及其作用：（1）酒及其作用：酒性大热，味甘、辛。能活血通络，祛风散寒，行药势，矫味矫臭。（2）醋及其作用：醋味酸、苦，性温。具有引药入肝、理气、止血、行水、消肿、解毒、散瘀止痛（A错）、矫味矫臭等作用。（3）盐水及其作用：食盐味咸，性寒。能强筋骨，软坚散结（D错），清热，凉血，解毒，防腐，并能矫味。（4）姜汁及其作用：生姜味辛，性温。升腾发散而走表，能发表，散寒，温中，止呕，开痰，解毒。药物经姜汁制后能抑制其寒性，增强疗效，降低毒性。（5）蜂蜜及其作用：蜂蜜生则性凉，故能清热；熟则性温，故能补中；以其甘而平和，故能解毒；柔而濡泽，故能润燥；缓可去急，故能止痛；气味香甜，故能矫味矫臭；不冷不燥，得中和之气，故十二脏腑之病，无不宜之。因而认为蜂蜜有调和药性的作用。用蜂蜜炮制药物，能与药物起协同作用，增强药物疗效或起解毒、缓和药物性能、矫味矫臭等作用。（6）油及其作用：麻油味甘，性微寒。具润燥通便，解毒生肌（E错）的作用。中药炮制中还有用到其他液体辅料的，主要有吴茱萸汁、白萝卜汁、羊脂油、鳖血、山羊血、石灰水、甘草汁、黑豆汁及其他药汁等。